13C-NMR中，C-3的信号在870左右的是
A. 二氢黄酮
B. 二氢黄酮醇
C. 黄酮醇
D. 异黄酮
E. 黄酮

正确答案：B。二氢黄酮醇